表示某市急性传染病的流行强度，宜用的指标是
A. 发病率
B. 死亡率
C. 患病率
D. 罹患率
E. 病死率

正确答案：A。发病率

解析：本题考查发病率的应用。发病率是指一定期间内，一定范围人群中某病新发生病例出现的频率。发病率（A对BCDE错）是疾病流行强度的指标，可反映疾病对人群健康影响的程度，发病率高对人群健康危害大。